卫生毒理学和毒理学的主要区别是
A. 毒理学相当于总论，而卫生毒理学是个论
B. 卫生毒理学与毒理学研究的方法有所不同
C. 卫生毒理学属于预防医学的范围，毒理学属于边缘学科
D. 卫生毒理学是毒理学的一个分支，毒理学是法医毒理学的分支
E. 卫生毒理学研究的范围越来越小，毒理学研究的范围越来越大

正确答案：C。卫生毒理学属于预防医学的范围，毒理学属于边缘学科